冠心病心绞痛的中医病因病机是
A. 寒邪内侵，饮食不节，情志失调
B. 正气虚弱，外邪侵袭，心血瘀阻
C. 情志失调，寒邪内侵，饮食不节，久病过劳
D. 先天禀赋不足，寒邪内侵，饮食不节，情志失调，年迈体衰
E. 寒邪内侵，饮食不节，情志失调，年迈体衰，痰湿内蕴

正确答案：E。寒邪内侵，饮食不节，情志失调，年迈体衰，痰湿内蕴

解析：冠心病心绞痛的发生与寒邪内侵，饮食不节，情志失调，年迈体衰，等因素有关，多种因素交互为患，引起心脉不畅而发病（E对）。寒邪内侵，饮食不节，情志失调是心绞痛的病因，但不全面（A错）。正气虚弱，外邪侵袭，心血瘀阻是风湿性心脏病的病机（B错）。情志失调，寒邪内侵，饮食不节，久病过劳也是冠心病心绞痛的病因却不全面（C错）。心绞痛一般是后天因素居多，与先天禀赋不足无直接关系（D错）。